下列有关全冠禁忌证，除外的是
A. 严重咬合紧
B. 严重深覆（牙合）
C. 无法预备足够的空间者
D. 牙体过小可取得固位形
E. 青少年恒牙因尚未发育完全

正确答案：D。牙体过小可取得固位形

解析：禁忌证①青少年恒牙因尚未发育完全，牙髓腔较大者。②牙体过小无法取得足够的固位形和抗力形者。③严重深覆（牙合）、咬合紧，而无法预备出足够的空间者。掌握“牙体缺损修复体固位及适应、禁忌证”知识点。